女，32岁。左下腹痛2个月，黄稀便，每日3次。结肠镜示：直肠、乙状结肠糜烂及浅溃疡，大范围充血、水肿。最可能的诊断是
A. 结肠癌
B. 慢性肠炎
C. 溃疡性结肠炎
D. 克罗恩病
E. 肠结核

正确答案：C。溃疡性结肠炎

解析：中青年女性患者，左下腹痛2月，伴有黄色稀便（符合溃疡性结肠炎的临床表现）。结肠镜：直肠、乙状结肠（溃疡性结肠炎的好发部位）糜烂及浅溃疡，大范围充血水肿（溃疡性结肠炎的结肠镜特点为：溃疡浅，黏膜弥漫性充血水肿、颗粒状，脆性增加）。综合该患者的病史与结肠镜检查，考虑诊断为溃疡性结肠炎（UC）（C对）。结肠癌（P382）（A错）发病年龄多在40～60岁，好发于直肠，多表现为鲜血便，直肠镜检可见火山状溃疡。慢性肠炎（B错）由急性肠炎迁延或反复发作而来，病程多在2个月以上，以腹痛、腹泻、稀水便或黏液脓血便为主要临床表现。克罗恩病（P377）（D错）好发于回肠末段，临床以腹痛、腹泻、体重下降、腹块、瘘管形成和肠梗阻为特点，结肠镜检查可见纵行溃疡和裂隙溃疡、鹅卵石征，病变间的黏膜正常。肠结核（P368）（E错）好发于回盲部，腹痛位于右下腹或脐周，常有结核毒血症状，结肠镜检查可见溃疡呈带状，长径与肠轴垂直。